有降低眼内压作用的药物是
A. 肾上腺素
B. 琥珀胆碱
C. 阿托品
D. 毛果芸香碱
E. 丙胺太林

正确答案：D。毛果芸香碱

解析：本题考查降低眼压的药物。毛果芸香碱（D对）具有缩小瞳孔和降低眼压的作用。肾上腺素（A错）滴眼液有降低眼压的作用，但肾上腺素注射不能降低眼压。琥珀胆碱（B错）为去极化型肌松药。阿托品（C错）具有散大瞳孔，使眼压升高的作用。丙胺太林（E错）具有与阿托品相似的M受体阻断作用，能够升高眼压。